医师李某，经考核合格，取得了麻醉药品和第一类精神药品的处方资格后，以下哪项做法是正确的
A. 他可以在医疗机构中开具麻醉药品和第一类精神药品处方
B. 他可以为所有病人开具麻醉药品处方
C. 如果他身患重病，他可以为自己开具麻醉药品处方
D. 他应当根据本单位的临床应用指导原则，使用麻醉药品和第一类精神药品
E. 他应当使用专用处方开具麻醉药品和第一类精神药品

正确答案：E。他应当使用专用处方开具麻醉药品和第一类精神药品

解析：取得购用印鉴卡的医疗机构中只有经考核合格、取得专门处方资格的执业医师才能开具麻醉药品和第一类精神药品处方；执业医师应当使用专用处方开具麻醉药品和精神药品。掌握“处方的开具、监督管理及法律责任”知识点。